牙髓塑化治疗时，拔髓的要求是
A. 保留根尖1/3处牙髓
B. 尽量拔除牙髓
C. 穿刺出根尖孔
D. 可以不拔除牙髓
E. 保留根尖2/3处牙髓

正确答案：B。尽量拔除牙髓

解析：本题考查塑化治疗。牙髓塑化治疗时，拔髓的要求是尽量拔除牙髓（B对）。牙髓塑化疗法的原理将处于液化状态的塑化剂充分注满已拔除绝大部分牙髓的根管中，塑化剂在聚合前可渗透进入侧、副根管壁的牙本质小管以及根管系统里、残存的病变牙髓组织和感染的物质中。需行塑化治疗的患牙,应尽量拔除牙髓,使根管内残剩物越少,塑化效果越好。导入塑化液时,器械的尖端只能达到根尖1/3处,切忌超出根尖孔（C错）,以免刺激根尖周组织。通常去除2/3的根髓就可以做塑化术，也能达到良好的效果，但最好是尽量去净（ADE错），没有残髓治疗效果更好。